环磷酰胺在体内转化为活性最强的代谢物是
A. 卡莫司汀
B. 磷酰胺氮芥
C. 磷酰胺
D. 丙烯醛
E. 异环磷酰胺

正确答案：B。磷酰胺氮芥